药师开展药学服务时，应该特别关注老年人用药，应做到
A. 反复交代用法用量，直至患者完全明白
B. 对药名或药品包装容易混淆的药物，应贴附提示标签
C. 有条件的应配备分时药盒
D. 掌握患者的整体情况，开展用药评估
E. 尽量采用专业术语让患者充分了解用药信息

正确答案：A、B、C、D。反复交代用法用量，直至患者完全明白；对药名或药品包装容易混淆的药物，应贴附提示标签；有条件的应配备分时药盒；掌握患者的整体情况，开展用药评估

解析：本题考查药学服务。药师开展药物服务应该关注特殊人群，老年人的听力、视力和用药依从性差，记忆力减退，应反复交代药品的用法用量和禁忌症，直至患者完全明白（A对）。在用药时宜选择每日仅服用1～2次的药品，书面写清楚用法并交代清晰（或贴附提示标签）（B对），有条件可配备分剂量药盒（C对）。掌握患者的整体情况，开展用药评估（D对）。药师需与患者进行沟通时尽量使用通俗易懂的语言，避免使用专业术语（E错）。